男，35岁。反复咳嗽伴呼吸困难20年，再发1天，吸入“万托林”或口服“氨茶碱片”后可缓解。查体：双肺闻及干湿啰音。外周血WBC7.8×10⁹/L，E0.15。与该病发生关系最密切的免疫球蛋白是
A. IgE
B. IgM
C. lgA
D. IgD
E. IgG

正确答案：A。IgE

解析：青年男性患者，反复咳嗽伴呼吸困难20年，吸入“万托林”（短效β2受体激动剂）或口服“氨茶碱片”（支气管扩张剂）后可缓解。查体：双肺闻及干湿啰音。查外周血WBC7.8×10⁹/L（正常），E0.15（升高，正常值为0.005～0.015），据患者病史、临床表现、体征及实验室检查，最可能的诊断为支气管哮喘。哮喘是与体液免疫相关的疾病，变应源进入机体后最终激活B淋巴细胞产生特异性抗体lgE（A对）。